患儿，3岁，形神疲惫，面色萎黄，嗜睡露睛，大便稀薄，四肢不温，足跗及面部轻度浮肿，神志不清，时或抽搐。治疗应首选
A. 缓肝理脾汤
B. 痛泻要方
C. 大定风珠
D. 苏合香丸
E. 参附汤

正确答案：A。缓肝理脾汤

解析：患儿形神疲惫，神志不清，时或抽搐，当属慢惊风，其来势缓慢，抽搐无力，时作时止，反复难愈，常伴昏迷、瘫痪。脾胃虚弱，脾土既虚，则脾虚肝旺，肝亢化风，致成慢惊之证，治以缓肝理脾汤，可温中健脾，缓肝理脾（A对）。痛泻要方主治脾虚肝旺之泄泻（B错）。大定风珠适于阴虚风动的慢惊风及多发性抽搐，症见抽搐反复发作、低热、舌红少苔、脉细数（C错）。苏合香丸芳香开窍，行气止痛，主治寒闭证（D错）。参附汤益气回阳救脱，主治阳气暴脱症（E错）。